桔梗的功效是
A. 润肺，止咳，下气，化痰
B. 宜肺，利咽，清肺，化痰
C. 宣肺，利咽，祛痰，排脓
D. 降气，止咳，祛痰，排脓
E. 降气，止呕，祛痰，排脓

正确答案：C。宣肺，利咽，祛痰，排脓

解析：桔梗具有宣肺，祛痰，利咽，排脓的功效（C对），可用于治疗咳嗽痰多，胸闷不畅，咽喉肿痛，失音，肺痈吐脓，又可宣开肺气而通二便，用治癃闭，便秘。